必须持有有关管理部门批件才能采猎的品种是
A. 闹阳花
B. 肉苁蓉
C. 火麻仁
D. 胖大海
E. 石菖蒲

正确答案：B。肉苁蓉

解析：本题考查国家重点保护野生药材采猎管理。必须持有有关管理部门批件才能采猎的品种是肉苁蓉（B对）。《野生药材资源保护管理条例》规定，禁止采猎一级保护野生药材物种。采猎、收购二、三级保护野生药材物种必须按照批准的计划执行。肉苁蓉属于三级保护药材，所以必须持有有关管理部门批件才能采猎。